口腔检查和修复前的准备问诊中包括
A. 主观要求
B. 社会背景
C. 既往口腔科治疗史
D. 性格和精神心理情况
E. 以上说法均正确

正确答案：E。以上说法均正确

解析：口腔检查和修复前的准备。问诊：①主观要求；②既往口腔科治疗史；③年龄、性别和全身健康状况；④性格和精神心理情况；⑤社会背景。掌握“全口义齿口腔检查及修复前准备”知识点。